女，25岁，平时无出血倾向，食欲良好。检查发现红细胞3×10¹²/L，Hb90g/L，WBC8.0×10⁹/L。血清总胆红素82μmol/L，非结合胆红素62μmol/L，ALT20μ，ALP10μ。若验尿，最可能出现的结果是
A. 尿胆原阴性，尿胆红素阴性
B. 尿胆原阳性，尿胆红素阴性
C. 尿胆原阴性，尿胆红素阳性
D. 尿胆原阳性，尿胆红素阳性
E. 尿胆原轻度增高，尿胆红素强阳性

正确答案：B。尿胆原阳性，尿胆红素阴性

解析：女，25岁，平时无出血倾向，食欲良好（排除其他影响因素）。检查发现红细胞3×10¹²/L（女性正常值为3.5～5.0×10¹²/L），Hb90g/L（女性正常值为110～150g/L），WBC8.0×10⁹/L（正常值为4～10×10⁹/L），提示患者存在贫血。血清总胆红素82μmol/L（正常值1.7-17.1μmol/L），非结合胆红素62μmol/L（正常值1.7-13.68μmol/L），ALT20U/L（正常值5～40U/L），ALP10U/L（正常值为40～150U/L），可诊断此病人的黄疸可能属于溶血性。溶血性黄疸实验室检查，以血清非结合胆红素（UCB）增高为主，结合胆红素（CB）基本正常。由于UCB增加，CB代偿性增加，从胆道排至肠道内的CB也增加，致肠内的尿胆原增加，尿中尿胆原增加，但并无胆红素，故验尿时尿胆原阳性，尿胆红素阴性（B对）。结合胆红素为水溶性，可通过肾小球滤过从尿中排出，正常人体中，尿胆红素阴性。尿胆红素强阳性、尿胆原阴性见于胆汁淤积性黄疸（AC错）。尿胆红素阳性见于肝细胞性黄疸（CDE错）。